检查早接触点最好用
A. 探针探查
B. 牙线检查
C. X线摄片
D. 摇动牙齿
E. 咬薄蜡片或咬合纸

正确答案：E。咬薄蜡片或咬合纸

解析：本题考查检查早接触点的方法。临床（牙合）检查的方法包括视诊、扪诊、咬合纸法、蜡片法、牙线法、研究模型、光（牙合）法、（牙合）力计法。早接触点是指正中（牙合）时只有个别牙接触，而不是广泛的亲密接触，这种个别牙的接触称为早接触点，最好用咬薄蜡片或咬合纸（E对）的方法，牙面上的浓密蓝点或蜡片上的菲薄透亮甚至穿孔区即为早接触点。探针探查（A错）、X线摄片（C错）、摇动牙齿（D错）无法检查出早接触点，主要用于龋病、牙髓病或牙松动度的检查。牙线法（B错）主要用于检查（牙合）干扰（前伸牙合或侧方牙合）的存在，确定（牙合）干扰的牙位后，进一步用咬合纸法或蜡片法确定该牙上的（牙合）干扰部位。